马拉硫磷为什么对昆虫有选择性毒性，而对人、畜毒性较小
A. 昆虫对马拉硫磷敏感
B. 昆虫体内羧酸脂酶丰富
C. 昆虫体内羧酸脂酶缺乏
D. 人体内羧酸脂酶缺乏
E. 人体对马拉硫磷不敏感

正确答案：C。昆虫体内羧酸脂酶缺乏